症见恶寒发热，头痛微汗出，胸闷欲呕，舌苔薄白，脉微略数，重按无力。其治宜
A. 葛根加半夏汤
B. 桂枝汤
C. 小建中汤
D. 桂枝去芍药汤
E. 小柴胡汤

正确答案：B。桂枝汤

解析：阳浮而阴弱，既指脉象之浮缓，又述病机之卫强营弱。风寒袭表，卫阳浮盛，故脉轻取显浮；由于汗出，营阴外泄，故脉沉取显弱。阳浮阴弱即脉浮缓之互称，是中风证的典型脉象。卫阳浮盛，故见发热，即所谓“阳浮者热自发”。中风证之发热，有似羽毛覆身而热势不盛，故原文用“翕翕发热”形容，为热在肌表之象。风性开泄，卫阳失固，营阴外泄，故见汗出，汗出则营阴更伤，即所谓“阴弱者汗自出”。卫气为风寒所伤，失其“温分肉”之职，加之汗出而肌疏，故见恶风、恶寒。既言“啬啬恶寒”，又言“淅淅恶风”，提示二者虽有轻重之别，又难截然区分。肺合皮毛，其气上通于鼻，外邪犯表，肺气不利，故见鼻鸣，即鼻塞而呼吸不畅之谓。外邪干胃，胃气上犯，则见干呕。其治法为解肌祛风，调和营卫，当以“桂枝汤主之”。所谓“主之”，即见此证则用此方，有可信任施用之意（B对）。